尿毒症患者血液系统的临床表现为
A. 正常细胞性贫血
B. 促红细胞生成素增加
C. 血小板异常增多
D. 贫血常为中重度
E. 以上各项均不正确

正确答案：A。正常细胞性贫血

解析：尿毒症患者血液系统表现主要为肾性贫血和出血倾向。多数患者均有轻、中度贫血（D错），主要是由于肾组织分泌促红细胞生成素（EPO）减少（B错）所致，表现为正细胞性贫血（A对）。晚期尿毒症患者，多有出血倾向，主要与血小板质量较差、功能降低，易被破坏，导致外周血小板数量减少（C错）有关，部分患者也可有凝血因子Ⅷ缺乏。